强心苷对下列哪种原因所致的慢性心功能不全疗效较好
A. 甲状腺功能亢进
B. 肺源性心脏病
C. 心力衰竭伴房颤
D. 缩窄性心包炎

正确答案：C。心力衰竭伴房颤

解析：本题考查慢性心力衰竭的药物治疗。强心苷对心力衰竭伴房颤（C对）所致的慢性心功能不全疗效较好。强心苷（代表药物有地高辛、洋地黄等）对心力衰竭伴房颤的慢性心功能不全疗效较好，可增强心肌收缩力。强心苷对代谢异常引起的高排血量心衰如甲状腺功能亢进（A错）所致心衰，洋地黄治疗效果欠佳。肺源性心脏病（B错）常伴低氧血症，与心肌梗死、缺血性心肌病均易发生洋地黄中毒，应慎用。缩窄性心包炎（D错）是心脏舒张功能受限引起的疾病，不需要使用正性肌力药物。